1个视黄醇活性当量（μgRAE）相当于
A. 1μg全反式视黄醇
B. 2μg全反式视黄醇
C. 3μg溶于油剂的纯品全反式β-胡萝卜素
D. 4μg膳食全反式β-胡萝卜素
E. 5μg其他膳食维生素A原类胡萝卜素

正确答案：A。1μg全反式视黄醇